行政复议机关负责法制工作的机构具体办理行政复议事项，履行下列职责
A. 受理行政复议申请
B. 向有关组织和人员调查取证，查阅文件和资料
C. 拟订申请复议理由和要求
D. 审查申请行政复议的具体行政行为是否合法和适当，拟订行政复议决定
E. 办理因不服行政复议决定提起行政诉讼的应诉事项

正确答案：A、B、D、E。受理行政复议申请；向有关组织和人员调查取证，查阅文件和资料；审查申请行政复议的具体行政行为是否合法和适当，拟订行政复议决定；办理因不服行政复议决定提起行政诉讼的应诉事项

解析：本题考查行政复议机关的职责。根据《行政复议法》第3条的规定，行政复议机关负责法制工作的机构是行政复议机构，具体办理行政复议事项，履行下列职责：①接受和审查申请（A对），除不予受理和依法转送的申请外，行政复议申请自行政复议机构收到之日起即为受理；②向有关组织和人员调查取证，查阅文件和资料（B对）；③审查申请行政复议的具体行政行为是否合法与适当，拟订行政复议决定（D对）；④处理或者转送对《行政复议法》第7条所列有关规定的审查申请；⑤对行政机关违反行政复议法规定的行为依照规定的权限和程序提出处理建议；⑥办理因不服行政复议决定提起行政诉讼的应诉事项（E对）；⑦法律、法规规定的其他职责。